乳牙列牙齿外伤更容易造成
A. 牙根折断
B. 牙冠折断
C. 牙根和牙冠联合折断
D. 牙齿移位
E. 牙根吸收

正确答案：D。牙齿移位

解析：乳牙列期牙槽骨骨质较疏松，乳牙外伤造成牙根或者牙冠的折断的较少，更容易造成牙齿移位或脱出。本题考查牙外伤概述及乳牙外伤。